终池
A. 位于蛛网膜下隙的中部
B. 内有马尾
C. 在硬膜下隙内
D. 自脊髓中部至第2骶椎水平
E. 不与脑蛛网膜下隙相通

正确答案：B。内有马尾

解析：终池位于脊髓蛛网膜下隙的下部（AC错），是自脊髓下端至第2骶椎之间（D错）扩大的蛛网膜下隙（E错），内有马尾（B对）.